阳明头痛，可选用的引经药是
A. 羌活、蔓荆子
B. 羌活、川芎
C. 葛根、白芷
D. 柴胡、川芎
E. 吴茱萸、藁本

正确答案：C。葛根、白芷

解析：治疗头痛，除根据辨证论治原则外，还可根据头痛的部位，参照经络循行部位选用适当的引经药，可以提高疗效。太阳头痛多在后头部，下连于项，选用羌活、蔓荆子治疗（A错）。羌活治疗太阳头痛，川芎能上行头目，太阳、少阳头痛均可用（B错）。阳明头痛多在前额及眉棱骨处，选用葛根、白芷、知母治疗（C对）。少阳头痛多在头两侧，并连及耳部，选用柴胡、黄芩、川芎治疗（D错）。厥阴头痛即巅顶头痛，可连于目系，选用吴茱萸、藁本治疗（E错）。